能被肾小管大部分重吸收的物质是
A. Na⁺
B. 葡萄糖
C. 菊粉
D. 肌酐
E. 对氨基马尿酸

正确答案：A。Na⁺

解析：能被肾小管大部分重吸收的物质是Na⁺（A对）。葡萄糖（B错）被肾小管全部重吸收。菊粉（C错）肾小管既不吸收也不分泌。肌酐（D错）不被肾小管重吸收，很少被肾小管排泌。对氨马尿酸（E错）除肾小球滤过外，大部分通过肾小管周围毛细血管向肾小管分泌后排出。